编制简略寿命表时，0岁组的死亡概率可
A. 用婴儿死亡率代替
B. 同其它组一样计算
C. 用新生儿死亡率代替
D. 以上均不对

正确答案：A。用婴儿死亡率代替

解析：本题考查简略寿命表的编制。编制简略寿命表时，0岁组的死亡概率可用婴儿死亡率代替（A对BCD错）。